某女，28岁。小便频数短涩，尿色黄赤，少腹拘急胀痛，腰痛拒按，大便秘结；舌红苔黄腻，脉滑数。宜选用的基础方剂是
A. 石韦散
B. 小蓟饮子
C. 八正散
D. 程氏萆薢分清饮
E. 沉香散

正确答案：C。八正散

解析：本题考查的是淋证的辨证论治。某女，28岁。小便频数短涩，尿色黄赤，少腹拘急胀痛，腰痛拒按，大便秘结；舌红苔黄腻，脉滑数。宜选用的基础方剂是八正散（C对）。淋证是指以小便频数短涩，淋沥刺痛，小腹拘急引痛为主症的疾病。西医学的泌尿系感染、尿路结石、前列腺炎、尿道综合征等病，具有淋证表现特征者，可参考此内容辨证论治。（一）热淋：【症状】小便频数短涩，灼热刺痛，尿色黄赤，少腹拘急胀痛，或有寒热，口苦，呕恶，或腰痛拒按，或大便秘结。舌质红，苔黄腻，脉滑数。【方剂应用】基础方剂为八正散（车前子、瞿麦、萹蓄、滑石、山栀子仁、甘草、木通、大黄、灯心草）加减。（二）石淋：【症状】尿中夹有砂石，排尿涩痛，或排尿时突然中断，尿道窘迫疼痛，少腹拘急，往往突发一侧腰腹绞痛难忍，甚则牵及外阴，尿中带血。舌质红，苔薄黄，脉弦或弦数。【方剂应用】基础方剂为石韦散（石韦、瞿麦、滑石、车前子、冬葵子）加减（A错）。（三）血淋：【症状】小便热涩刺痛，尿色深红，或夹有血块，疼痛满急加剧，或见心烦。舌尖红，舌苔黄，脉滑数。【方剂应用】基础方剂为小蓟饮子（小蓟、生地黄、滑石、木通、蒲黄、藕节、淡竹叶、当归、山栀子、甘草）加减（B错）。（四）气淋：【症状】郁怒之后，小便涩滞，淋沥不宣，少腹胀满疼痛。舌苔薄白，脉弦。【方剂应用】基础方剂为沉香散（沉香、石韦、滑石、当归、橘皮、白芍、冬葵子、甘草、王不留行）加减（E错）。（五）膏淋：【症状】小便浑浊，乳白或如米泔水，上有浮油，置之沉淀，或伴有絮状凝块物，或混有血液、血块，尿时热涩疼痛，口干。舌质红，苔黄腻，脉濡数。【方剂应用】基础方剂为程氏萆薢分清饮（萆薢、黄柏、石菖蒲、茯苓、白术、莲子心、丹参、车前子）加减（D错）。（六）劳淋：【症状】小便不甚赤涩，溺痛不甚，但淋沥不已，时作时止，遇劳即发，腰膝酸软，神疲乏力，病程缠绵。舌质淡，脉细弱。【方剂应用】基础方剂为无比山药丸（山药、肉苁蓉、熟地黄、山茱萸、茯神、菟丝子、五味子、赤石脂、巴戟天、泽泻、杜仲、牛膝）加减。